《中国药典》规定，应检查二氧化硫残留量且含量不得过400mg/kg的药材是
A. 石菖蒲
B. 天麻
C. 薏苡仁
D. 槟榔
E. 酸枣仁

正确答案：B。天麻

解析：本题考查的是二氧化硫的残留量检查。《中国药典》规定，应检查二氧化硫残留量且含量不得过400mg/kg的药材是天麻（B对）。二氧化硫的残留量检查：有的中药材在加工或储藏中常使用硫黄熏蒸以达到杀菌防腐、漂白药材的目的。《中国药典》用酸碱滴定法、气相色谱法、离子色谱法分别作为第一法、第二法、第三法测定经硫黄熏蒸处理过的药材或饮片中二氧化硫的残留量。规定二氧化硫残留量不得过400mg/kg的药材和饮片有毛山药、光山药、天冬、天花粉、天麻、牛膝、白及、白术、白芍、党参、粉葛等。山药片不得过10mg/kg。薏苡仁（C错）、槟榔（D错）与酸枣仁（E错）需检查黄曲霉毒素。黄曲霉毒素为黄曲霉等的代谢产物，是强烈的致癌物质。各国对食品和药品中黄曲霉毒素的限量都做了严格的规定，但目前还没有公认的植物药中黄曲霉毒素的限量标准。《中国药典》规定用高效液相色谱法测定药材、饮片及制剂中的黄曲霉毒素（以黄曲霉毒素B₁、B₂、G₁和G₂总量计）的限量，第一法为高效液相色谱-柱后衍生化法，第二法为高效液相色谱-串联质谱法，并规定当测定结果超出限度时，采用第二法进行确认。需进行黄曲霉毒素限量检查的药材和饮片有：大枣、水蛭、地龙、肉豆蔻、全蝎、决明子、麦芽、陈皮、使君子、柏子仁、胖大海、莲子、桃仁、蜈蚣、槟榔、酸枣仁、僵蚕、薏苡仁等，并规定每1000g样品中含黄曲霉素B₁不得过5μg，黄曲霉毒素B₁、B₂、G₁和G₂的总量不得过10μg。